土壤大肠菌值是
A. 100g土壤发现的大肠菌群数
B. 发现大肠菌的最少土壤克数
C. 1g土壤中发现的大肠菌群数
D. 发现一个大肠菌群的土壤千克数
E. 土壤中大肠菌群数

正确答案：B。发现大肠菌的最少土壤克数

解析：本题考查土壤大肠菌值。大肠菌值是发现大肠菌的最少土壤克数（B对ACDE错），它是代表人畜粪便污染的主要指标，也是代表肠道传染病危险性的主要指标。